与病理缩复环关系最密切的是
A. 双胎妊娠
B. 先兆子痫
C. 子宫收缩过强
D. 胎盘早剥
E. 嵌顿性肩先露

正确答案：E。嵌顿性肩先露

解析：嵌顿性肩先露使子宫收缩继续增强，子宫上段越来越厚，子宫下段被动扩张越来越薄，由于子宫上下段肌壁厚薄相差悬殊，形成环状凹陷，并随宫缩逐渐升高，甚至可以高达脐上，形成病理缩复环。故与病理缩复环关系最密切的是嵌顿性肩先露（E对）。